关于甲硝唑作用特点和用药注意事项的说法，错误的是
A. 甲硝唑有致突变和致畸作用
B. 甲硝唑半衰期比奥硝唑短
C. 甲硝唑属于时间依赖型抗菌药物
D. 甲硝唑代谢产物可能使尿液颜色加深
E. 服用甲硝唑期间禁止饮酒

正确答案：C。甲硝唑属于时间依赖型抗菌药物

解析：本题考查甲硝唑作用特点和用药注意事项。甲硝唑属于浓度依赖型抗菌药物，而不是时间依赖型抗菌药物（C错，为本题正确答案）。甲硝唑有致突变和致畸作用（A对）。甲硝唑半衰期为8.4h，短于奥硝唑的14.4h（B对）。甲硝唑的代谢产物可使尿液呈深红色（D对）。服用甲硝唑及之后7日禁止饮酒（E对）。